为比较工人干部中高血压患者所占比例有无不同，进行了X²检验，X²值为9.56，X²（0.05，1）=3.84，若取α=0.05应得出的结论是
A. 接受π1=π2
B. 拒绝π1=π2
C. 接受π1＞π2
D. 拒绝π1＞π2
E. 拒绝μ1=μ2

正确答案：B。拒绝π1=π2

解析：c2检验零假设H0为π1=π2，本题中c2=9.56，c2＞c2（0.05），以按α=0.05为水准，推断P＜0.05，拒绝H0（B对A错）。检验假设中不存在π1>π2的表达方式（CD错）。μ1=μ2为t检验的零假设H0（E错）。